以下哪项为健康教育的基础
A. 调查研究
B. 血液检测
C. 社区宣传
D. 小组讨论
E. 在线交流

正确答案：A。调查研究

解析：健康教育在调查研究的基础上采用健康信息传播等干预措施促使人群或个体自觉采纳有利于健康的行为和生活方式，从而避免或减少暴露于危险因素。掌握“干预基本模式及烟草行为干预”知识点。